眼轴为
A. 眼球前面角膜正中点和后面巩膜正中点的连线
B. 视网膜中央凹到瞳孔中央的连线
C. 眶口正中点与视神经管的连线
D. 角膜正中点与视神经盘正中点的连线
E. 玻璃体中轴的延长线

正确答案：A。眼球前面角膜正中点和后面巩膜正中点的连线

解析：眼轴为眼球前面正中点的前极和后面正中点的后极的连线，即眼球前面角膜正中点和后面巩膜正中点的连线（A对）。